患者，女，57岁。有15年肺胀病史。1周前，劳累后出现面部水肿，呼吸喘促难续，心悸，胸脘痞闷，尿少，怕冷，纳呆，舌苔白滑，脉沉细。治疗应首选
A. 济生肾气丸
B. 真武汤
C. 实脾饮
D. 参附汤
E. 金匮肾气丸

正确答案：B。真武汤

解析：肺脾肾阳气衰微，气不化水，水邪泛滥则面部水肿；水饮上凌心肺，故心悸，呼吸喘促难续；脾阳虚衰，健运失常则胸脘痞闷，纳呆；寒水内盛故尿少，怕冷；舌苔白滑，脉沉细为阳虚水停之征。故诊断为阳虚水泛证，治宜温肾健脾，化饮利水，方选真武汤合五苓散加减（B对）。济生肾气丸功能温补肾气，利水消肿，为治疗臌胀阳虚水盛证选方（A错）。实脾饮功能健运脾阳，以利水湿，为治疗水肿之脾阳虚衰证选方（C错）。参附汤功能大补元气，温补心阳，为治疗胸痹心肾阳虚证选方（D错）。金匮肾气丸功能温补肾阳，为治疗喘证之肾虚不纳证的选方（E错）。